DALY指标是评价人口健康的
A. 生理学指标
B. 心理学指标
C. 生存健康指标
D. 生命长度指标
E. 复合指标

正确答案：E。复合指标